主要用于防止间日疟复发和传播的药物是
A. 氯喹
B. 奎宁
C. 青蒿素
D. 伯氨喹
E. 甲氟喹

正确答案：D。伯氨喹

解析：主要用于防止间日疟复发和传播的药物是伯氨喹（D对）。氯喹（A错）是非耐药疟疾的首选药物。奎宁（B错）用于耐氯喹疟原虫株感染患者。青蒿素及其衍生物（C错）为我国耐氯喹疟疾的首选药物。甲氟喹（E错）为无青蒿琥酯国家耐氯喹疟疾的首选药物。